关于铅的说法，错误的是
A. 血铅是铅内暴露的重要指标
B. 铅只对神经系统有毒性
C. 儿童对铅的毒性比成人更敏感
D. 儿童血铅在100μg/L时，可以出现学习能力的下降
E. 铅可通过胎盘进入胎儿体内

正确答案：B。铅只对神经系统有毒性

解析：本题考查铅的相关内容。血铅值反映近期铅的摄入量，常作为铅内暴露水平的重要指标（A对）。铅是全身性毒物，可以影响多个系统，对神经系统、消化系统、造血系统、泌尿系统、心血管系统、免疫系统和内分泌系统均有不良影响（B错，为本题正确答案）。儿童对铅的毒性比成人更敏感（C对），儿童血铅在100μg/L时，可以出现学习能力的下降（D对）。处于器官发生、发育阶段的胎儿对铅作用十分敏感。母体内的铅可以通过胎盘进入胎儿体内（E对），造成母源性铅中毒或过量铅吸收。母亲孕期长期暴露于高浓度的铅可导致新生儿出现低体重、贫血、出生缺陷、死产等。